下列配伍变化，属于物理配伍变化的是
A. 水杨酸遇铁盐颜色变深
B. 硫酸镁溶液与碳酸氢钠溶液混合产生沉淀
C. 芳香水中加入一定量的盐可使挥发油分离出来
D. 维生素B₁₂与维生素C混合制成溶液时，维生素B₁₂效价显著降低
E. 乌洛托品与酸性药物配伍产生甲醛

正确答案：C。芳香水中加入一定量的盐可使挥发油分离出来

解析：本题考查物理配伍变化。物理配伍变化常见的有：①溶解度改变：含黏液质、蛋白质多的水溶液若加入多量的醇能产生沉淀。②潮解、液化和结块：散剂、颗粒剂由于药物吸湿后又逐渐干燥而结块。③分散状态或粒径变化：乳剂、混悬剂中分散相的粒径可因与其他药物配伍，也可因久贮而粒径变大。芳香水中加入一定量的盐可使挥发油分离出来（C对）即为物理配伍变化。